如果某项检验指标高低度与疾病有联系时，将诊断标准降低一个稀释度则很可能会导致
A. 灵敏度和特异度都增加
B. 特异度减小而灵敏度增加
C. 灵敏度减小而特异度增加
D. 灵敏度，特异度都减小
E. 灵敏度增加，特异度则根据周围情况培加或减小

正确答案：B。特异度减小而灵敏度增加

解析：本题考查筛检试验真实性评价指标。如果某项检验指标高滴度与疾病有联系时，将诊断标准降低一个稀释度则很可能会导致特异度减小而灵敏度增加（B对ACDE错），诊断标准降低会使更多的病人被筛检出来，提高了灵敏度而使特异度降低。